丘脑的特异性投射系统的主要作用是
A. 协调肌紧张
B. 维持觉醒
C. 调节内脏功能
D. 引起特定感觉
E. 引起牵涉痛

正确答案：D。引起特定感觉